抗菌药物的监督管理主要是由
A. 抗菌药物处方点评
B. 抗菌药物医嘱点评
C. 对抗菌药物超常处方医师的处理
D. 取消医师抗菌药物处方权的情形
E. 以上说法均正确

正确答案：E。以上说法均正确

解析：监督管理：①抗菌药物处方、医嘱点评；②对抗菌药物超常处方医师的处理；③取消医师抗菌药物处方权的情形。掌握“抗菌药物临床应用、监督及法律责任”知识点。